患者，女，25岁，大便干结7天，腹胀腹痛，面红耳热，口干口臭，心烦不安，小便短赤，舌红苔黄燥，脉滑数，其治法是
A. 清热通腑，健脾和胃
B. 清肠化湿，调气和血
C. 清热解毒，通腑止痛
D. 泻热通腑，化瘀导滞
E. 泻热导滞，润肠通便

正确答案：E。泻热导滞，润肠通便

解析：根据患者“大便干结7天”，辨为“便秘”，根据“大便干结，腹胀或痛，口干口臭，面红心烦，或有身热，小便短赤，舌红，苔黄燥，脉滑数”，辨为“热秘”。患者肠腹燥热，津伤便结，治宜泻热导滞，润肠通便（E对），方选麻子仁丸加减。